患者外感风寒，恶寒发热，头身疼痛，无汗，喘咳。治疗宜选用
A. 麻黄
B. 桂枝
C. 细辛
D. 杏仁
E. 白前

正确答案：A。麻黄

解析：该题考查麻黄的临床应用。患者外感风寒，恶寒发热，头身疼痛，无汗为伤寒表实证，治以发散风寒，咳喘以宣肺平喘。麻黄具有发散风寒，宣肺平喘，利水消肿的功效，宜用于风寒外郁，腠理密闭无汗的外感风寒表实证，并且麻黄味辛为治疗肺气壅遏所致喘咳的要药（A对）。桂枝具有发汗解肌，温通经脉，助阳化气的功效，善于宣阳气于卫分，畅营血于肌表，没有宣肺平喘的功效（B错）。细辛具有解表散寒，祛风止痛，通窍，温肺化饮的功效，宜于外感风寒，头身疼痛较甚者，并且主治风寒咳喘证或寒饮咳喘证，通鼻窍功能较强，发散解表功能较麻黄弱（C错）。杏仁具有止咳平喘，润肠通便的功效，肃降兼宣发肺气而能止咳平喘，没有发散风寒的功效（D错）。白前具有降气化痰的功效，没有发散风寒，长于祛痰，降肺气以平咳喘，宣肺平喘的功效（E错）。